能滋阴养胃的中成药是
A. 养胃舒胶囊
B. 加味左金丸
C. 温胃舒胶囊
D. 香砂平胃丸
E. 开胃山楂丸

正确答案：A。养胃舒胶囊

解析：本题考查的是养胃舒胶囊的功能。能滋阴养胃的中成药是养胃舒胶囊（A对）。养胃舒胶囊：【功能】益气养阴，健脾和胃，行气导滞。香砂平胃丸（D错）：【功能】理气化湿，和胃止痛。加味左金丸（B错）、温胃舒胶囊（C错）与开胃山楂丸（E错）的功能，2022年考试指南未明确说明。